评价室内空气清洁度和居室容积的最重要指标是
A. SO₂
B. CO
C. CO₂
D. O₃
E. 颗粒物

正确答案：C。CO₂

解析：本题考查评价室内空气清洁度和居室容积的最重要指标。室内空气中CO₂（C对ABDE错）的含量是用作评价空气清洁度的一个重要指标，也是作为居室容积是否符合卫生要求的重要指标之一。